长期服用避孕药者至少应停药多长时间才宜怀孕
A. 1周
B. 2周
C. 3周
D. 1个月
E. 6个月

正确答案：E。6个月

解析：本题考查常用的避孕方法。长期服用避孕药者至少应停药6个月（E对ABCD错）才宜怀孕，避孕药在临床上可以抑制卵巢排卵，并且改变子宫内膜的厚度，停药以后在体内造成的影响才会逐渐消除，所以建议最好是恢复6次月经之后，并且每次月经都正常的情况下再准备怀孕。